关于痴呆的临床特点，最正确的是
A. 是先天或大脑发育成熟以前由于各种致病因素，造成智力低下
B. 老人儿童均可发生
C. 多数病人意识不清晰
D. 早期可表现为近记忆减退
E. 常无器质性病变

正确答案：D。早期可表现为近记忆减退

解析：痴呆的发生多缓慢隐匿，早期出现近记忆障碍（D对），学习新事物的能力明显减退，严重者甚至找不到回家的路。痴呆主要发生于老人，而且年龄越大患病率越高（B错）。痴呆是指较严重的、持续的认知障碍，以缓慢出现的智能减退为主要特征，伴有不同程度的人格改变，但无意识障碍（C错）。痴呆是由多种器质性病变（E错）导致的精神障碍，这些器质性病变包括阿茨海默病（最常见）、脑血管疾病、脑肿瘤、缺氧等。